病人舌苔厚腻如积粉的临床意义是
A. 痰饮上泛
B. 湿邪夹热毒
C. 食积内停
D. 湿浊内蕴
E. 痰湿化热

正确答案：B。湿邪夹热毒

解析：外感秽浊之气，热毒内盛，秽浊之邪与热毒相结上熏，可致苔白如积粉，扪之不燥，即积粉苔（B对）。